毒毛花苷K的主要药理作用有
A. 加强心肌收缩力
B. 松弛支气管平滑肌
C. 解除胃肠道痉挛
D. 减慢房室传导
E. 减慢心率

正确答案：A、D、E。加强心肌收缩力；减慢房室传导；减慢心率

解析：本题考查毒毛花苷K。毒毛花苷K的主要药理作用有加强心肌收缩力（A对）、减慢房室传导（D对）、减慢心率（E对）。毒毛花苷K通过抑制心肌细胞Na⁺，K⁺-ATP酶，使细胞内Na⁺水平升高，促进Na⁺-Ca²⁺交换，提高细胞内Ca²⁺水平，从而发挥正性肌力作用。同时该药也使副交感Na⁺，K⁺-ATP酶受抑制，使中枢神经下达的交感兴奋减弱，从而使房室传导减慢，心率减慢。能够松弛支气管平滑肌（B错）的药物有β₂受体激动剂，如沙丁胺醇。解除胃肠道痉挛（C错）可选用M受体阻滞剂，如阿托品。